引起人类原发性非典型肺炎的病原体是
A. 肺炎链球菌
B. 肺炎支原体
C. 嗜肺军团菌
D. 冠状病毒
E. 溶脲脲原体

正确答案：B。肺炎支原体